男性，30岁。突起呼吸困难，两肺满布以呼气相为主的哮鸣音，无湿哕音，心界不大，心率100次/分，律齐，未闻及心脏杂音并见咳痰色黄，口渴，面赤红，苔黄腻，脉滑数。应首先考虑的治疗药物是
A. β受体激动药吸入与射干麻黄汤
B. 氨茶碱与玉屏风散
C. 喘定与小青龙汤
D. 异丙肾上腺素与金匮肾气丸
E. 糖皮质激素与定喘汤

正确答案：E。糖皮质激素与定喘汤

解析：哮喘热哮证症状：气粗息涌，咳呛阵作，喉中哮鸣，胸高胁胀，烦闷不安；汗出口渴喜饮，面赤口苦，咳痰色黄或色白，黏浊稠厚，咯吐不利，不恶寒。舌质红，苔黄腻，脉滑数或弦滑。治法：清热宣肺，化痰定喘。方药：定喘汤（E对）。射干麻黄汤治疗哮喘发作期的寒哮证，其症状为呼吸急促，喉中哮鸣有声，胸膈满闷如塞；咳不甚，咯吐不爽，痰稀薄色白，面色晦滞带青，口不渴或渴喜热饮，天冷或受寒易发，形寒畏冷；初起多兼恶寒、发热、头痛等表证。舌苔白滑，脉弦紧或浮紧（A错）。玉屏风散治疗哮喘缓解期肺虚证，其症状：喘促气短，语声低微，面色㿠白，自汗畏风；咳痰清稀色白，多因气候变化而诱发，发前喷嚏频作，鼻塞流清涕。舌淡苔白，脉细弱或虚大（B错）。金匮肾气丸或七味都气丸加减治疗哮喘缓解期肾虚证，其症状：平素息促气短，呼多吸少，动则为甚；形瘦神疲心悸，腰酸腿软，脑转耳鸣，劳累后哮喘易发；或面色苍白，畏寒肢冷，自汗，或红，烦热，汗出黏手。舌淡苔白质胖，或舌红少苔，脉沉细或细数（D错误），C选项书中未提及到。